有关活动性原发型肺结核的治疗错误的
A. 宜采用分阶段治疗方案
B. 强化治疗采用INH+RFP+PZA
C. 巩固维持治疗采用INH+PZA
D. RFP疗程6～12个月
E. INH疗程12～18个月

正确答案：C。巩固维持治疗采用INH+PZA

解析：肺结核化学治疗的原则是早期、规律、全程、联合、适量。INH为异烟肼，RFP为利福平，PZA为吡嗪酰胺。活动性原发型肺结核宜分阶段治疗（A对），在强化治疗阶段宜用三种杀菌药，即INH、RFP、PZA（B对）或SM（链霉素），两到三个月后以INH、RFP或EMB巩固维持治疗（C错，为本题正确答案），RFP及EMB疗程为6～12个月（D对），INH疗程12～18个月（E对）。